以下哪一项不属于慢性唇炎的临床表现
A. 脱屑
B. 糜烂
C. 结痂
D. 肿胀
E. 放射状斑纹

正确答案：E。放射状斑纹

解析：放射状斑纹多见于盘状红斑狼疮。掌握“慢性非特异性唇炎”知识点。